当医务人员存在“乳胶过敏症”时可使用
A. 棉手套
B. 腈制品手套
C. 外科消毒手套
D. 塑料薄膜手套
E. 以上都可以

正确答案：B。腈制品手套

解析：乙烯基手套：有些医护人员可能对乳胶有严重的过敏反应，这种“乳胶过敏症”是一种接触性皮炎。一直以来，推荐乳胶手套过敏者使用乙烯基手套，但据最新研究报道乙烯基手套的屏障作用时间只有5～10分钟，不可作为口腔科检查与治疗用途。目前，建议过敏者使用腈制品手套。掌握“患者、医务人员及环境的防护”知识点。